氨氯地平用于高血压的初始计量的是
A. 每次1mg
B. 每次2.5mg
C. 每次4mg
D. 每次5mg
E. 每次12.5mg

正确答案：D。每次5mg

解析：本题考查氨氯地平的使用。氨氯地平用于高血压的初始计量的是每次5mg（D对）。氨氯地平可用于高血压，稳定型和不稳定型心绞痛。口服初始剂量一次5mg，一日1次，最高剂量一次10mg, 一日1次。与其他抗高血压药合用时，一次2.5mg（B错），一日1次。对肾功能损害者可采用正常剂量。老年人宜从小剂量开始，渐增剂量。